女性，21岁。3年来有发作性头痛，部位不定，每日1~2次，持续十几小时，伴恶心、呕吐、畏光，神经科体检未见明显异常。进一步需要进行的检查是
A. 头颅CT和脑电图
B. 脑电图和脑血管造影
C. 血电解质检查
D. 内科检查
E. 肌电图

正确答案：A。头颅CT和脑电图